缺O₂和CO₂潴留对中枢神经系统可产生的影响，不包括
A. 出现烦躁、不安、谵妄
B. 出现神志不清、昏迷
C. 导致脑组织碱中毒
D. 导致脑细胞内水肿
E. 导致脑间质水肿

正确答案：C。导致脑组织碱中毒

解析：脑组织的耗氧量很大，低氧对中枢神经系统的影响与缺氧发生的速度和程度有关，PaO₂降至40～50mmHg以下时，会引起一系列神经症状，如头痛、嗜睡、记忆力障碍、精神错乱，降至30mmHg以下时，出现神志丧失乃至昏迷（B对）。CO₂潴留使脑脊液H⁺浓度增加，导致脑组织酸中毒（C错，为本题正确答案）。CO₂潴留还可引起留头痛、头晕、烦躁不安（A对）、言语不清、扑翼样震颤。缺氧时细胞ATP生成减少，造成Na⁺～K⁺泵功能障碍，引起细胞内Na⁺及水分增多，形成脑细胞水肿（D对）。缺氧和酸中毒还能损伤血管内皮细胞使其通透性增高，导致脑间质水肿（E对）。